某女，65岁。恶寒重，发热轻，头身疼痛，鼻塞，流清涕，舌淡，苔白，脉浮紧。给予正柴胡饮颗粒。为增强疗效，执业药师建议可使用的药引和服用方法是
A. 清茶送服
B. 生姜煎汤送服
C. 黄酒送服
D. 米汤送服
E. 淡盐水送服

正确答案：B。生姜煎汤送服

解析：本题考查的是中成药与药引的配伍应用。对恶寒重，发热轻，头身疼痛，鼻塞，流清涕，舌淡，苔白，脉浮紧。给予正柴胡饮颗粒。为增强疗效，执业药师建议可使用的药引和服用方法是生姜煎汤送服（B对）。中成药与药引的配伍应用：所谓药引又称药引子，是指根据病情的需要和剂型的特点，选用适当的中药饮片或辅料，经煎煮或加热后配合成药或成方使用的物质。如对外感风寒或脾胃虚寒之呕吐泄泻等病证，常用生姜、大枣煎汤送服中成药，如治风寒表实咳嗽的通宣理肺丸、温中散寒的附子理中丸、和中解表的藿香正气水等，以增强散风寒、和脾胃、温中止呕之功，一般用生姜3～5片，水煎取汤送服。对于跌打损伤、风寒湿痹等证，常用黄酒或白酒送服（C错）三七粉、云南白药、三七伤药片、七厘散、大活络丸、再造丸、醒消丸、跌打丸、独活寄生丸、腰痛宁胶囊等，以行药势，直达病所，黄酒一般用15～20ml，白酒酌减。用于治疗便秘的麻仁丸，宜用蜂蜜冲水送服，以增其润肠和中之效。米汤具有温养脾胃、顾护胃气的功效，还可减少药物对肠胃的刺激，因此凡脾胃虚弱，素有胃肠道疾患的患者服用更衣丸、麻仁丸、消渴丸、四神丸等，以及服用治疗身体衰弱的补益类中成药如十全大补丸、人参养荣丸等，宜用米汤送服（D错），小米、大米汤汁均可。滋阴补肾的六味地黄丸、大补阴丸等宜用淡盐水送服（E错），以取其引药入肾之功。清热导滞的至宝锭用焦三仙煎汤送服，以增强消导之功。治疗风热感冒的银翘解毒丸用鲜芦根煎汤送服，取其清热透表生津的协同作用。川芎茶调散用清茶送服（A错），取其清热之效。